女性，50岁，下颌6521│12356缺失，余留牙正常。行可摘局部义齿时，基牙应该选择
A. 743│47
B. 74│47
C. 73│47
D. 43│47
E. 73│7

正确答案：B。74│47

解析：本题考查可摘局部义齿基牙的选择。女性，50岁，下颌6521│12356缺失（Kennedy第三类第二亚类），余留牙正常。行可摘局部义齿时，基牙应该选择74│47（B对）。基牙是可摘局部义齿修复的基础，选择基牙时应综合支持固位就位道等方面进行考虑，要是可摘局部义齿有良好的固位与稳定。可摘局部义齿中基牙的选择主要有以下要求：1.选择健康牙作为基牙，临床上一般多选用后牙，对美观要求高者慎选尖牙。2.患牙经治疗后做基牙。3.选择固位形好的做基牙。4.基牙数目恰当：一般2～4个。5.基牙位置合适：首选近缺牙间院两端的天然牙作基牙。缺牙间隙的一端选用2个牙作基牙时，2个基牙之间愈远愈好。选用多个基牙时，彼此愈分散愈好，使在基牙上的义齿固位体呈面支承状态。743│47（A错）基牙数目太多，一般2～4个。73│47（C错）、43│47（D错)、73│7（E错）都选择了尖牙，不利于美观，且不够分散，不能很好地使在基牙上的义齿固位体呈面支承状态，故最合适的基牙应选择74│47。